下列关于表面活性剂毒性按大小顺序的排列中，正确的是
A. 阴离子型＞阳离子型＞非离子型
B. 阳离子型＞非离子型＞阴离子型
C. 非离子型＞阴离子型＞阳离子型
D. 阴离子型＞非离子型＞阳离子型
E. 阳离子型＞阴离子型＞非离子型

正确答案：E。阳离子型＞阴离子型＞非离子型

解析：本题考查的是表面活性剂的毒性。关于表面活性剂毒性按大小顺序的排列中，正确的是阳离子型＞阴离子型＞非离子型（E对）。表面活性剂按其解离情况不同分为离子型和非离子型两大类，其中离子型表面活性剂又分为阴离子型、阳离子型和两性离子型表面活性剂三类。（1）阴离子型表面活性剂：本类表面活性剂起表面活性作用的是阴离子。主要包括高级脂肪酸盐、硫酸化物以及磺酸化物。①高级脂肪酸盐：又称肥皂类。本类表面活性剂具有一定的刺激性，一般只用于外用制剂。②硫酸化物：为硫酸化油和高级脂肪醇的硫酸酯类。其乳化能力很强，并较肥皂类稳定，主要用于外用软膏的乳化剂。③磺酸化物：主要有脂肪族磺酸化物、烷基芳基磺酸化物、烷基萘磺酸化物等。广泛用作洗涤剂。（2）阳离子型表面活性剂：本类表面活性剂分子结构中起表面活性作用的是阳离子，即分子结构中含有一个五价的氮原子，又称季铵化物。其水溶性大，在酸性或碱性溶液中均较稳定，具有良好的表面活性和杀菌作用，但毒性大，主要用于皮肤器械等消毒。（3）两性离子型表面活性剂：本类表面活性剂的分子结构中同时含有阴阳离子基团，在不同pH介质中可表现出阴离子或阳离子表面活性剂的性质，即在碱性水溶液中呈现阴离子表面活性剂的性质，具有较好的起泡性，去污力；在酸性水溶液中则呈现阳离子表面活性剂的性质，具有很强的杀菌能力。（4）非离子型表面活性剂：本类表面活性剂在水中不解离，其分子结构中亲水基团多为甘油、聚乙二醇和山梨醇等多元醇，亲油基团多为长链脂肪酸或长链脂肪醇以及烷基或芳基等，以酯键或醚键相结合。本类表面活性剂广泛应用于外用制剂、内服制剂，少数品种可用于注射剂。